男，65岁。排便次数增加6个月，伴里急后重、排便不尽感。1个月来大便变细，偶有大便表面带血，自觉乏力，体重减轻4Kg。该疾病最常见的远处转移部位是
A. 脾
B. 肝脏
C. 骨骼
D. 脑
E. 肺

正确答案：B。肝脏

解析：老年男性患者，排便次数增加6个月，伴里急后重、排便不尽感（直肠刺激症状）。1个月来大便变细，偶有大便表面带血，自觉乏力，体重减轻4Kg。综合患者的症状、体征，初步诊断为直肠癌。该疾病最常见的远处转移部位是肝脏（B对）。脾（A错）、骨骼（C错）、脑（D错）、肺（E错）均不是结直肠癌最常见的远处转移部位。